药学职业道德的基本内容不包括
A. 遵守社会公德
B. 慎言守密
C. 坚持社会效益和经济效益并重
D. 重视病人对药品不良反应的诉说
E. 不可轻信病人对病症的诉说

正确答案：E。不可轻信病人对病症的诉说